将玩具从一手换入另一手的月龄
A. 7月
B. 9月
C. 12月
D. 15月
E. 18月

正确答案：A。7月

解析：7个月会翻身，独坐很久，将玩具换手。掌握“运动和语言发育”知识点。